男婴，其母G₂P₁，足月顺产，生后10h出现黄疸，血胆红素为306μmol/L。患儿可能的诊断是
A. ABO溶血病
B. Rh溶血病
C. 生理性黄疸
D. 败血症
E. 胆道闭锁

正确答案：B。Rh溶血病

解析：Rh溶血病多发生于再次妊娠时，多在患儿生后24小时内出现黄疸并迅速加重。本例男婴的母亲G2P1，即孕2产1，男婴生后10小时出现黄疸，故首先考虑Rh溶血病（B对）。ABO溶血病（P116）常发生于第一胎，多在生后2-3天出现黄疸（A错）。足月儿生后10小时出现黄疸，血胆红素306μmmol/L（正常值＜221μmmol/L），应该诊断为病理性黄疸（P114），而不是生理性黄疸（C错）。新生儿败血症（P122）常表现为黄疸退而复现，且往往较重（D错）。新生儿胆道闭锁（P115）常常于生后24小时出现黄疸，且较重，以直接胆红素升高为主（E错）。